楔状缺损不常见于牙齿的
A. 唇侧
B. 颊侧
C. 牙颈部
D. 舌侧
E. 釉牙骨质界处

正确答案：D。舌侧

解析：本题考查楔状缺损。楔状缺损不常见于牙齿的舌侧（D错，为本题的正确答案）。楔状缺损不发生在牙齿的舌面。楔状缺损是一种非龋性牙颈部慢性损伤，是指发生在牙齿唇、颊面颈部的慢性硬组织缺损。楔状缺损的病因：1.内因：牙颈部标志性的解剖结构是釉牙骨质界（E对），当釉牙骨质界表现为牙釉质和牙骨质端端相接或两者不相连时，牙本质极易受到物理和化学因素的破坏。加之牙齿受力时，应力集中于牙颈部。长期应力集中会导致牙齿硬组织疲劳。牙齿舌面受到的主要是压应力，唇颊面是拉应力。因拉应力的破坏性更大，故楔状缺损主要发生在唇颊面（AB对）；牙颈部（C对）的牙釉质薄，甚至缺如，加之被龈沟包绕，龈沟内有酸性渗出物，这些因素使牙颈部硬组织的破坏更易发生。2.外因：刷牙不当与楔状缺损有密切关系：①不刷牙的人较少发生楔状缺损，横向刷牙者，常有严重的楔状缺损；②楔状缺损不发生在牙齿的舌面；③唇向错位的牙楔状缺损常比较严重；④楔状缺损的牙常伴有牙龈退缩，牙根暴露。研究还发现，楔状缺损的严重程度与牙刷刷毛的硬度、牙膏中颗粒的直径、刷牙的力度呈正相关关系。